女，36岁，发热，面色苍白，伴牙龈出血一周入院。入院次日起出现皮肤多处片状瘀斑血尿。血红蛋白80g/L，白细胞2.0×10⁹/L，血小板50×10⁹/L，血浆纤维蛋白原0.8g/L。骨髓检查：有核细胞增生极度活跃，细胞浆颗粒粗大的早幼粒细胞占85%。获得完全缓解后的治疗策略是
A. 化疗与全反式维甲酸交替治疗
B. 单用全反式维甲酸维持治疗
C. 定期联合化疗
D. 中剂量阿糖胞苷强化治疗
E. 停药，定期随诊

正确答案：A。化疗与全反式维甲酸交替治疗

解析：患者诊断为急性早幼粒细胞白血病，在给予诱导治疗获得完全缓解后可采用化疗、ATRA（全反式维甲酸）以及砷剂等药物交替维持治疗近2年（A对）。